某女，68岁。素患青光眼，刻下心悸不安，胸闷气短，动则尤甚，面色苍白，形寒肢冷，下肢浮肿，夜间不能平卧；舌淡苔白，脉虚弱。诊断为心悸。根据患者病史，应禁用的中成药是
A. 参仙升脉口服液
B. 参桂胶囊
C. 心力丸
D. 心宝丸
E. 活心丸

正确答案：D。心宝丸

解析：本题考查心悸之心阳不振证的合理用药与用药指导。青光眼患者不宜选用心宝丸（D对）。心悸之心阳不振证【症状】心悸不安，胸闷气短，动则尤甚，面色苍白，形寒肢冷。舌淡苔白，脉虚弱或沉细无力。【中成药应用】参仙升脉口服液、心宝丸、芪苈强心胶囊。合理用药与用药指导：（1）以上三药均可用于心阳不振之心悸。心肾阳虚、瘀血阻脉之心悸（如病态窦房结综合征）宜选用参仙升脉口服液或心宝丸。阳气亏虚，血瘀水停之心悸兼喘促、水肿者，宜选用芪苈强心胶囊或心宝丸。（2）孕妇、哺乳期妇女、运动员、合并高血压及严重心脏病者，均慎用参仙升脉口服液（A错）。肝阳上亢、湿热内盛者禁用参仙升脉口服液；病态窦房结综合征中的慢－快综合征及病态窦房结综合征病情需安装起搏器者，均不宜使用参仙升脉口服液；服药期间应注意心率、血压的变化，并采取相应的治疗措施。孕妇、经期妇女、青光眼患者禁用心宝丸。阴虚内热、肝阳上亢、痰火内盛者不宜使用心宝丸。正在服用洋地黄类药物者慎用心宝丸，本品中含附子、洋金花、蟾酥，不宜过量服用及久服；有临床报道患者在服用心宝丸后出现过敏反应。孕妇慎用芪苈强心胶囊。芪苈强心胶囊宜饭后服用。胸痹之气虚血瘀证【症状】胸痛隐隐，遇劳则发，神疲乏力，气短懒言，心悸自汗。舌胖有齿痕，色淡暗，苔薄白，脉弱而涩，或结、代。【中成药应用】参桂胶囊（B错）、芪参益气滴丸、心力丸（C错）、活心丸（E错）。合理用药指导：孕妇禁用心力丸、活心丸；慎用参桂胶囊、芪参益气滴丸。胸痹属阴虚证者及经期妇女慎用心力丸、活心丸。正在服用洋地黄类药物的患者慎用心力丸、活心丸，因其含有具强心作用的蟾酥。心力丸、活心丸皆宜饭后服用。少数患者在服用参桂胶囊期间会出现口干、口渴症状。有文献报道口服活心丸可致颜面水肿。